女，35岁。间断咳嗽、咳脓痰伴咯血10余年，再发2天入院。咯血总量约600ml，经抗感染、静脉点滴垂体后叶素治疗后咯血停止。行胸部X线检查示多发囊状及柱状影，部分囊腔内可见液平，余肺未见异常。该患者进一步采取的最佳治疗措施是
A. 支气管动脉栓塞
B. 规律使用流感疫苗
C. 感染时联合使用抗生素
D. 手术切除病变肺叶
E. 抗生素预防感染

正确答案：A。支气管动脉栓塞

解析：患者间断咳嗽、咳痰、咯血多年，胸片示多发囊状及柱状影，可见液平，应诊断为支气管扩张症。对于反复咯血的支扩患者，若咯血量少，可口服安络血、云南白药；若出血量中等，可静滴垂体后叶素；若出血量大，内科治疗无效，可考虑介入拴塞或手术治疗。本例反复咯血10余年，近2天咯血600ml，说明咯血量极大，应行介入治疗或手术治疗，因此答案可能为A或D。手术切除病肺治疗支扩，目前极少应用，仅适用于局限于1～2个肺叶的支扩、大咯血经支气管动脉栓塞无效者。只有当栓塞治疗无效时，才考虑手术，且要求为局限性支扩，因此答案为A，而不是D；支扩患者仅在儿童期规律使用流感疫苗有益，本例为35岁妇女，故不答B。当支扩急性感染期出现痰量增多时才考虑联合使用抗生素，本例为咯血量增加，故不答C。抗生素预防感染可减少支扩急性发作的次数，不能用于咯血的治疗。掌握“支气管扩张”知识点。